成年男性，体检用ELISA试验发现血液中HIV抗体阳性。确认实验用
A. PCR法查DNA
B. 分离培养病毒
C. 检测病毒抗原
D. 蛋白印迹（ Western blot-ting）
E. RT-PCR查RNA

正确答案：D。蛋白印迹（ Western blot-ting）